溶菌酶的溶菌作用机理是
A. 裂解细胞壁聚糖骨架上的β-1，4糖苷键
B. 抑制细胞壁肽聚糖上四肽侧链与五肽桥的交联
C. 抑制细菌mRNA表达
D. 抑制细菌DNA转录
E. 破坏细胞壁上的磷壁酸

正确答案：A。裂解细胞壁聚糖骨架上的β-1，4糖苷键

解析：溶菌酶的溶菌作用机理是裂解肽聚糖中N-乙酰葡萄糖胺和N-乙酰胞壁酸之间的β-1，4糖苷键（A对），破坏聚糖骨架，引起细菌裂解。能抑制细胞壁肽聚糖上四肽侧链与五肽桥的交联（B错）有青霉素类、头孢菌素类、万古霉素等（八版药理学P360）。能抑制细菌mRNA表达（C错）的包括四环素类、大观霉素、红霉素等（八版药理学P360）。可抑制DNA转录（D错）的为利福平，能抑制细菌DNA依赖的RNA多聚酶，阻碍mRNA的合成，从而抑制DNA转录（八版药理学P360）。暂无抗生素的作用靶位点是细胞壁上的磷壁酸（E错）。